骨髓检查巨核细胞明显减少最常见于
A. 缺铁性贫血
B. 再生障碍性贫血
C. 巨幼细胞性贫血
D. 特发性血小板减少性紫癜
E. 溶血性贫血

正确答案：B。再生障碍性贫血

解析：骨髓检查巨核细胞明显减少最常见于再生障碍性贫血，再生障碍性贫血时，骨髓造血功能衰竭，增生减低或重度减低，粒、红系及巨核细胞均明显减少（B对）；缺铁性贫血（P541）（A错）、巨幼细胞性贫血（P544）（C错）、溶血性贫血（E错）时，红细胞生成减少或破坏过多，但骨髓检查骨髓增生活跃或明显活跃，以红系为主，除巨幼细胞性贫血可有粒系、巨核系巨幼变外，其他均对巨核系无明显影响；特发性血小板减少性紫癜（P616）（D错）是由于体液免疫或细胞免疫介导的血小板过度破坏和血小板生成受抑而引起的血小板减少症，骨髓检查巨核细胞数正常或增多，有成熟障碍。